以下治疗蛛网膜下腔出血的措施不妥的是
A. 卧床休息4～6周
B. 应用止血药物
C. 低分子肝素注射
D. 静滴20%甘露醇
E. 口服尼莫地平

正确答案：C。低分子肝素注射

解析：蛛网膜下腔出血的治疗目标主要有四个：防治再出血、降低颅内压、防治继发性脑血管痉挛、减少并发症（P197）。绝对卧床休息4～6周（A对）可减少再出血的可能。蛛网膜下腔出血不同于脑出血，出血部位没有脑组织的压迫止血作用，应适当应用止血药物（B对）预防再出血。静滴20%甘露醇（D对）可以降低颅内压，为临床一般处理。口服尼莫地平（E对）可以很好的起到防治继发性脑血管痉挛的作用（P198）。而低分子肝素（C错，为本题正确答案）是抗凝药物，会加重出血，禁用于蛛网膜下腔出血。